治疗肝硬化脾肾阳虚证，应首选
A. 柴胡疏肝散
B. 调营饮
C. 附子理中汤合五苓散
D. 一贯煎合膈下逐瘀汤
E. 胃苓汤

正确答案：C。附子理中汤合五苓散

解析：肝硬化脾肾阳虚证，治宜温肾补脾，化气利水，首选温阳祛寒，补气健脾的附子理中汤合利水渗湿，温阳化气的五苓散（C对）。柴胡疏肝散功用疏肝解郁，行气止痛，与胃苓汤合用可用于肝硬化气滞湿阻证（A错）。调营汤活血化瘀，化气行水，是治疗肝硬化肝脾血瘀证的代表方（B错）。一贯煎合膈下逐瘀汤滋养肝肾，化气利水，适用于肝硬化肝肾阴虚证（D错）。胃苓汤功用祛湿和胃，行气利水，主治夏秋之间，脾胃伤冷，水谷不分，泄泻如水者（E错）。